患者，女，28岁，妊娠28周，诊断为妊娠期糖尿病。首选的降糖药物是
A. 瑞格列奈
B. 阿卡波糖
C. 二甲双胍
D. 沙格列汀
E. 胰岛素

正确答案：E。胰岛素

解析：本题考查妊娠期糖尿病者首选药。妊娠糖尿病首选胰岛素（E对）进行治疗。瑞格列奈（A错）为非磺酰脲类促胰岛素分泌药，吸收快、起效快，作用时间短，既可降低空腹血糖，又可降低餐后血糖，无需餐前0.5h服用，因而又称为“餐时血糖调节剂”。阿卡波糖（B错）属于α-葡萄糖苷酶抑制剂，可作为单纯餐后血糖高，而空腹和餐前血糖不高的首选。二甲双胍（C错）首选用于单纯饮食控制及体育锻炼治疗无效的2型糖尿病，特别是肥胖的2型糖尿病，对磺酰脲类疗效差的糖尿病患者与磺酰脲类口服降血糖药合用。沙格列汀（D错）可作为单药治疗，在饮食和运动基础上改善血糖控制。当单独使用盐酸二甲双胍血糖控制不佳时，可与盐酸二甲双胍联合使用，在饮食和运动基础上改善血糖控制。